下列有关左主支气管的描述何者正确
A. 比右主支气管短
B. 在奇静脉下方通过
C. 位于食管胸部之后
D. 在左肺动脉之下方到达肺门
E. 上述全不对

正确答案：D。在左肺动脉之下方到达肺门

解析：左主支气管比右主支气管长（A错）。左主支气管位于食管胸部之前（C错）。左主支气管在左肺动脉之下方到达肺门（D对）。